1967年，Tolonen对粘纤厂接触CS₂的333名工人及造纸厂333名无CS₂接触的工人进行调查并随访5年，其中接触CS₂工人中心肌梗塞发生25例，无CS₂接触工人有7例发生心肌梗死。RR为
A. 1
B. 0.08
C. 0.02
D. 0.2
E. 3.57

正确答案：E。3.57

解析：本题考查相对危险度的计算。相对危险度比是暴露组的危险度（测量指标是累积发病率）与对照组的危险度之比。计算为相对危险度＝（25/333）/（7/333）＝3.57（E对ABCD错）。